不属于宫颈癌常规筛查的方法是
A. 传统宫颈细胞涂片检查
B. 钼靶检查
C. 高危型人乳头瘤病毒（HPV）DNA检测
D. 阴道镜检查
E. 醋酸/复方碘染色肉眼观察法

正确答案：B。钼靶检查

解析：本题考查宫颈癌筛查的方法。筛查早期乳腺癌最效的方式还是乳腺的钼靶检查（B错，为本题正确答案），乳腺的钼靶检查可以发现临床触及不到、超声也看不到的极其微小的钙化病变。目前较常用于宫颈癌筛查的方法有：传统的巴氏涂片（A对）、3%～5%醋酸（VIA）和Lugols碘液（VILI）宫颈视诊（E对）、计算机辅助细胞学检测系统（CCT）、液基薄层细胞学检测（LCT）、HPV检测（C对）、阴道镜（D对）等。但任何一种宫颈癌的 筛查方法都有其不足。对于筛查对象而言，密切的随访，有助于医师传递更多的知识，帮助其更好地依从筛查和治疗方案，从而真正实现宫颈癌筛查的二级和三级预防作用。